小蓟的主治病证是
A. 血热尿血
B. 肺痨咳血
C. 虚寒便血
D. 湿热便血
E. 气虚崩漏

正确答案：A。血热尿血

解析：本题考查的是小蓟的主治病证。小蓟的主治病证是血热尿血（A对）。小蓟：【主治病证】（1）血热之尿血、血淋、咳血、衄血、吐血、崩漏，外伤出血。（2）热毒痈肿。鹿衔草：【主治病证】（1）风湿痹痛，腰膝酸软。（2）崩漏经多，白带不止。（3）肺虚久咳，肺痨咳血（B错）。（4）劳伤吐血，外伤出血。炮姜：【主治病证】（1）虚寒性吐血、便血（C错）、崩漏等证。（2）脾胃虚寒之腹痛、吐泻等。椿皮：【主治病证】（1）久泻久痢，湿热泻痢，便血（D错）。（2）崩漏，赤白带下。（3）蛔虫病。（4）疮癣作痒。升麻：【主治病证】（1）风热头痛，麻疹透发不畅。（2）热毒疮肿，丹毒，痄腮，咽喉肿痛，口舌生疮，温毒发斑。（3）气虚下陷之久泻脱肛、崩漏（E错）下血及胃下垂、子宫脱垂等。